梅毒感染的妇女不宜采取的避孕方法是
A. 避孕药
B. 宫内节育器
C. 自然避孕
D. 输卵管绝育术
E. 避孕套

正确答案：B。宫内节育器

解析：本题考查常用的避孕方法。梅毒感染的妇女不宜采取的避孕方法是宫内节育器（B错，为本题正确答案）。梅毒感染的妇女可采用避孕药（A对）、自然避孕（C对）、输卵管绝育术（D对）、避孕套（E对）等方式进行避孕。